下列有关RNA分类、分布及结构的叙述错误的是
A. 主要有mRNA、tRNA和rRNA三类
B. tRNA分子量比mRNA和rRNA小
C. 胞质中只有mRNA
D. rRNA可与蛋白质结合
E. RNA并不全是单链结构

正确答案：C。胞质中只有mRNA

解析：RNA通常以单链形式存在，但可以通过链内的碱基配对形成局部的双链二级结构和空间的高级结构（E对），细胞中主要有mRNA、tRNA和rRNA三类（A对），三者均可以在细胞质中存在（C错，为本题正确答案）。rRNA与核糖体蛋白共同构成核糖体（D对）。原核生物有3种rRNA（P48），依照分子量的大小分为5S、16S和32S，其中5S的rRNA含有120个核苷酸；tRNA（P47）是由74～95个核苷酸组成的；在真核生物mRNA由3＇端多聚A尾、5＇帽结构和编码区组成，其中3＇端多聚A尾是一段由80～250个腺甘酸连接而成的多聚腺苷酸结构。因此tRNA分子量比mRNA和rRNA小（B对）。